促进肌肉发达增加爆发力的兴奋剂
A. 呋塞米
B. 甲睾酮
C. 哌替啶
D. 苯丙胺
E. 哌唑嗪

正确答案：B。甲睾酮

解析：本题考查兴奋剂的分类。甲睾酮（B对）为蛋白同化激素，蛋白同化制剂又称同化激素，俗称合成类固醇，是合成代谢类药物，具有促进蛋白质合成和减少氨基酸分解的特征，可促进肌肉增生，提高动作力度和增强男性的性特征。我国对此类药品类的兴奋剂实行特殊管理。呋塞米（A错）为利尿剂。哌替啶（C错）为麻醉止痛剂。苯丙胺（D错）为精神刺激药。哌唑嗪（E错）不属于兴奋剂。